不属于阻塞性肺气肿的体征是
A. 桶状胸
B. 触觉语颤增强
C. 肺下界和肝浊音界下降
D. 叩诊呈过清音、心浊音界缩小或不易叩出
E. 肺泡呼吸音降低，呼气明显延长

正确答案：B。触觉语颤增强

解析：肺气肿体征：桶状胸、语音震颤减弱、叩诊呈过清音、两肺呼吸音减弱，呼气延长。掌握“慢性阻塞性肺疾病”知识点。